下列关于麻疹预防、护理的那项不正确
A. 流行期，未患过麻疹的小儿尽量不去公共场所
B. 一旦与麻疹患儿接触，应立即隔离观察
C. 出疹期间勿洗脸、洗眼
D. 注意补足水分
E. 卧室空气要流通

正确答案：C。出疹期间勿洗脸、洗眼

解析：麻疹预防：易感儿进行麻疹减毒活疫苗预防接种，麻疹流行期间，避免去公共场所及探亲访友（A对）。对麻疹患者做到早诊断、早报告、早治疗。患儿隔离至出疹后5天，并发肺炎者，延长隔离至出疹后10天（B对）。其调护：患儿应卧床休息，居室空气要流通（E对），保持适当温度和湿度，有畏光症状时室内光线要柔和；注意补充水分（D对），给予易消化、富含营养的食物；保持患儿皮肤、眼睛、鼻腔及口腔的清洁，勤换内衣，注意消毒（C错，为本题正确答案）。